肝硬化最常见的并发症是
A. 上消化道出血
B. 肝性脑病
C. 感染
D. 肝肾综合征
E. 肝肺综合征

正确答案：A。上消化道出血